苯的氨基和硝基化合物大多属于
A. 沸点高、挥发性高的固体或液体
B. 沸点低、挥发性低的固体或液体
C. 沸点高、挥发性低的固体或液体
D. 沸点低、挥发性高的固体或液体
E. 沸点低、蒸气压高的固体或液体

正确答案：C。沸点高、挥发性低的固体或液体

解析：本题考查苯的氨基和硝基化合物的物理性质。苯的氨基和硝基化合物多具有沸点高、挥发性低，常温下呈固体或液体状态（C对ABDE错），多难溶或不溶于水，而易溶于脂肪、醇、醚、氯仿及其他有机溶剂等理化性质。